患者，女，25岁。痛经2年，经行不畅，小腹胀痛拒按，经色紫红，夹有瘀块，血块下后痛可缓解，舌有瘀斑，脉沉涩。治疗应以哪组经脉腧穴为主
A. 任脉、足少阴经
B. 任脉、足阳明经
C. 督脉、足厥阴经
D. 任脉、足太阴经
E. 督脉、足阳明经

正确答案：D。任脉、足太阴经

解析：患者痛经，其瘀血阻络，故见经行不畅，小腹胀痛拒按，经色紫红，夹有瘀块，舌脉亦为佐证，故为实证，治疗应选用足太阴经及任脉穴为主，以通经止痛，调理冲任（D对）。足少阴经为肾经，不能通经止痛（A错）。足阳明胃经可用于虚证痛经（B错）。相对于督脉，女子的月经与冲任关系较密切，本患者无明显的气滞，足厥阴肝经不为首选（C错）。如前述，督脉、足阳明经非此证主穴（E错）。